临床上常用舌侧基托代替舌侧卡环臂，起到对抗臂作用的卡环
A. 倒钩卡环
B. 三臂卡环
C. 连续卡环
D. 联合卡环
E. 对半卡环

正确答案：E。对半卡环

解析：对半卡环：由颊、舌侧两个相对的卡环臂和近、远中支托组成，用于前后有缺隙、孤立的前磨牙或磨牙上。临床上常用舌侧基托代替舌侧卡环臂，起到对抗臂的作用。掌握“局部义齿固位体”知识点。